喹诺酮类药可治疗的疾病是
A. 伤寒
B. 复杂性尿路感染
C. 敏感细菌引起的呼吸道感染
D. 革兰阳性菌引起的骨髓和关节炎
E. 梅毒

正确答案：A、B、C、D。伤寒；复杂性尿路感染；敏感细菌引起的呼吸道感染；革兰阳性菌引起的骨髓和关节炎

解析：本题考查喹诺酮类药物的适应证。喹诺酮类药可治疗的疾病是伤寒（A对）、复杂性尿路感染（B对）、敏感细菌引起的呼吸道感染（C对）、革兰阳性菌引起的骨髓和关节炎（D对）。氟喹诺酮类对需氧革兰阳性、阴性菌均具有良好抗菌作用，尤其对革兰阴性杆菌活性强。伤寒是由伤寒杆菌引起的，伤寒杆菌属革兰氏阴性杆菌。复杂性尿路感染病原菌大肠埃希杆菌属革兰氏阴性杆菌。敏感细菌引起的呼吸道感染由大多数革兰氏阴性菌、部分革兰氏阳性菌和支原体致病的。梅毒（E错）是由梅毒螺旋体致病的，氟喹诺酮类药对其作用小。